洁净剂约占牙膏含量的
A. 1%～2%
B. 2%～4%
C. 20%～40%
D. 20%～60%
E. 0.1%～0.5%

正确答案：A。1%～2%

解析：洁净剂：又称发泡剂或表面活化剂，约占1%～2%。掌握“自我口腔保健方法”知识点。